慢性复发性腮腺炎的病理表现为
A. 小叶内导管上皮鳞状化生和纤维间质内淋巴滤泡生成
B. 小叶内导管囊状扩张，淋巴滤泡形成，腺泡萎缩
C. 导管周围纤维化，小叶间结缔组织增生
D. 腺泡萎缩，结缔组织玻璃样变，导管上皮鳞状化生
E. 流出的脓液样唾液镜下可见分枝状的菌丝

正确答案：B。小叶内导管囊状扩张，淋巴滤泡形成，腺泡萎缩

解析：慢性复发性腮腺炎镜下见小叶内导管囊状扩张，导管上皮增生，囊壁为一至数层扁平上皮，囊腔可融合；附近导管周围有淋巴细胞浸润或形成淋巴滤泡；腺泡细胞萎缩。唇腺活检表现为腺体萎缩，间质中淋巴细胞浸润。掌握“慢性唾液腺炎的病理变化”知识点。